患儿，男，出生7天。面目皮肤发黄，色泽晦暗，精神差，吮乳少，四肢欠温，腹胀便溏，舌淡苔白腻，指纹色淡。其诊断是
A. 新生儿黄疸湿热熏蒸证
B. 新生儿黄疸寒湿阻滞证
C. 新生儿黄疸瘀积发黄证
D. 新生儿生理性黄疸
E. 以上均非

正确答案：B。新生儿黄疸寒湿阻滞证

解析：本病例以面目皮肤发黄为主症，结合患儿年龄7天及其他症状，故诊断为新生儿黄疸，属于病理性黄疸。小儿先天不足，脾阳虚弱，以致湿从寒化，阻滞脾胃，故见面目皮肤发黄，色泽晦暗；寒湿内蕴，中阳素微，故见精神差，吮乳少，四肢欠温，腹胀便溏；舌淡苔白腻，指纹色淡，为阳气不足，寒湿内盛之象，故其诊断为新生儿黄疸之寒湿阻滞证（B对）。新生儿黄疸湿热熏蒸证（A错）其临床表现为面目皮肤发黄，颜色鲜明，精神疲倦或烦躁啼哭，不欲吮乳，小便短黄，舌红苔黄腻，指纹滞。新生儿黄疸瘀积发黄证（C错）其临床表现为面目皮肤发黄，颜色晦滞，日益加重，腹部胀满，右胁下痞块，神疲纳呆，小便短黄，大便不调或灰白，舌紫暗有瘀斑瘀点，苔黄或白。新生儿生理性黄疸一般情况良好（D错）。